乌梅的功效有
A. 敛肺
B. 安蛔
C. 生津
D. 止带
E. 补肝肾

正确答案：A、B、C。敛肺；安蛔；生津

解析：本题考查的是乌梅的功效。乌梅的功效有敛肺（A对）、安蛔（B对）与生津（C对）。乌梅：【功效】敛肺，涩肠，生津，安蛔，止血。椿皮：【功效】清热燥湿，涩肠，止血，止带（D错），杀虫。山茱萸：【功效】补益肝肾（E错），收敛固脱。